牙周炎与下列心脑血管疾病关联不大的是
A. 慢性冠心病
B. 急性心肌梗死
C. 蛛网膜下腔出血
D. 急性感染性心内膜炎
E. 亚急性感染性心内膜炎

正确答案：C。蛛网膜下腔出血

解析：口腔感染引起急性或亚急性感染性心内膜炎是牙周病与全身健康有关的最为明显和肯定的例子。牙周炎与急性心肌梗死和慢性冠心病的关系近年来也得到证实。掌握“牙周疾病与全身疾病和健康的关系”知识点。